LD₅₀与ED₅₀的比值是
A. 最小有效量
B. 效能
C. 效价强度
D. 治疗指数
E. 安全范围

正确答案：D。治疗指数

解析：本题考查药物的治疗指数。LD₅₀与ED₅₀的比值是治疗指数（D对）。药物的安全性一般与其LD₅₀的大小成正比，与ED₅₀成反比，故常以药物LD₅₀和ED₅₀的比值表示药物的安全性，称为治疗指数（TI）。治疗指数越大药物相对越安全。最小有效量（A错）是指引起药理效应的最小药量，也称阈剂量。效能（B错）反映了药物的内在活性，在质反应中阳性率100%。在一定范围内，增加药物剂量或浓度，其效应随之增加，但效应增至一定程度时，若继续增加剂量或浓度而效应不再继续增强，此药理效应的极限称为最大效应，也称效能。效价强度（C错）是指能引起等效反应（一般采用50%效应量）的相对剂量或浓度。安全范围（E错）是指ED₉₅和LD₅之间的距离，其值越大越安全。